对骨质疏松伴骨折引起的慢性疼痛者宜选用
A. 钙制剂+维生素D+双膦酸盐
B. 维生素D
C. 钙制剂+维生素+雌激素
D. 特拉唑嗪
E. 降钙素

正确答案：E。降钙素

解析：本题考查骨质疏松症的药物治疗。对骨质疏松伴骨折引起的慢性疼痛者宜选用降钙素（E对）。钙制剂+维生素D+双膦酸盐（A错）用于老年性骨质疏松症。长期口服维生素D（B错）用于治疗抗癫痫药所致OP。钙制剂+维生素+雌激素（C错）用于防治女性绝经后OP。特拉唑嗪（D错）用于治疗轻度或中度前列腺增生引起的排尿困难和轻度或中度高血压。